男，65岁。高血压病史10余年，既往有痛风病史。查体：BP180/100mmHg，双肺呼吸音清，心率50次/分，律齐，心脏各瓣膜区未闻及杂音。实验室检查：血Cr320μmol/L。该患者最适宜的降压药物是
A. 血管紧张素转换酶抑制剂
B. 噻嗪类利尿剂
C. 血管紧张素Ⅱ受体阻滞剂
D. 钙通道阻滞剂
E. β受体阻滞剂

正确答案：D。钙通道阻滞剂

解析：患者老年男性，有痛风病史，BP180/100mmHg（正常值90～139/60～89mmHg，提示重度高血压），心率缓慢（50次/分），血Cr320μmol/L。血管紧张素转换酶抑制剂（A错）和血管紧张素Ⅱ受体阻滞剂（C错）在血肌酐超过3mg/dL（1mg/dL=88.41μmol/L），即265μmol/L时，需谨慎使用，本例患者血Cr（血肌酐）320μmol/L，因此两者都不适合作为降压药。噻嗪类利尿剂（B错）可升高血糖、血脂和血尿酸，禁用于痛风患者。β受体阻滞剂（E错）可拮抗中枢交感神经，使心率降低，本例患者心率本来就缓慢（50次/分），若使用可进一步降低心率，导致严重心动过缓而出现一系列临床症状。综合病史来看，该患者最适宜的降压药物是钙通道阻滞剂中的二氢吡啶类药物，如非洛地平缓释片、硝苯地平缓释片等。其不仅适合于老年人收缩期高血压，而且可使交感活性反射性增强，使患者心率加快，且对血尿酸和肾功能无明显影响，因此可作为本例患者首选。非二氢吡啶类药物可抑制心肌收缩和传导，并降低患者心率，也不适合心室率缓慢的高血压患者。本题选项中并无二氢吡啶类钙通道阻滞剂，因此最佳答案应选择钙通道阻滞剂（D对）。